下列各项中，有特殊鼠尿味的是
A. 白秃疮病
B. 脚湿气
C. 肥疮
D. 体癣
E. 花斑癣

正确答案：C。肥疮

解析：白秃疮皮损特征是在头皮有圆形或不规则的覆盖灰白鳞屑的斑片，病损区毛发干枯无泽，常在距头皮0.3~0.8cm处折断而呈参差不齐，无鼠尿臭（A错）。脚湿气病主要发生在趾缝，以皮下水疱、趾间浸渍糜烂、渗流滋水，角化过度，脱屑，瘙痒为特征，无鼠尿臭（B错）。肥疮：其特征是：有黄癣痂堆积，癣痂呈蜡黄色，肥厚，富黏性，边缘翘起，中心微凹，上有毛发贯穿，质脆易粉碎，有特殊的鼠尿臭（C对）。圆癣的皮损特征为环形或多环形、边界清楚、中心消退、外围扩张的斑块，无鼠尿臭（D错）花斑癣皮损好发于颈项、躯干，尤其是多汗部位以及四肢近心端，为大小不一、边界清楚的圆形或不规则的无炎症性斑块，色淡褐、灰褐至深褐色，或轻度色素减退，或附少许糠秕状细鳞屑，常融合成片，无鼠尿臭（E错）。